胰腺癌，常伴有
A. 慢性规律性的上腹痛
B. 无规律性的上腹痛
C. 右上腹绞痛
D. 左上腹剧痛
E. 皮肤粘膜出血

正确答案：D。左上腹剧痛

解析：胰腺癌指胰外分泌腺的恶性肿瘤，表现为腹痛、食欲不振、消瘦、黄疸等。腹痛多为首发症状，早期腹痛较轻或位置不定，以后逐渐加重且位置固定。典型腹痛为：持续、进行性加剧的左、中上腹痛或持续腰背部剧痛，可有阵发性绞痛（D对）。慢性规律性上腹痛（A错）慢性规律性上腹痛（A错）多见于胃、十二指肠溃疡疾病。右上腹绞痛（C错）常见于急性胆囊炎、胆石病。皮肤粘膜出血（E错）见于紫癜、肝硬化肝功能不良等。无规律性的上腹痛（B错）见于胃炎等疾病。